食品生产经营风险分级管理工作应当遵循的原则不包括
A. 风险分析
B. 量化评价
C. 动态管理
D. 客观公正
E. 全程控制

正确答案：E。全程控制